主要以速释为目的的栓剂是
A. 中空栓剂
B. 渗透泵栓剂
C. 凝胶栓剂
D. 双层栓剂
E. 微囊栓剂

正确答案：A。中空栓剂

解析：本题考查栓剂。中空栓剂（A对）溶出速度比普通栓剂要快，可达到快速释药目的；渗透泵型栓剂（B错）、凝胶栓剂（C错）均为缓释型栓剂；双层栓剂（D错）的药物具有不同的释放速度，可速释可缓释；微囊栓剂（E错）中药物释放具有缓、控释的特点，属于缓、控释栓剂。